患者小便量极少而短赤灼热，小腹胀满，口苦口黏，口渴不欲饮，舌苔黄腻，脉数。治疗应首选
A. 八正散
B. 导赤散
C. 沉香散
D. 济生肾气丸
E. 清肺饮

正确答案：A。八正散

解析：患者小便量极少诊断为癃闭；湿热壅积于膀胱，故小便不利而短赤灼热；湿热互结，膀胱气化不利，故小腹胀满；湿热内盛故口苦口黏；津液不布，故口渴不欲饮；苔黄腻，脉数均为下焦湿热所致；治宜清利湿热，通利小便，方选八正散（A对）。导赤散功用清心利水养阴，用于治疗心经火热证（B错）。沉香散用于癃闭肝郁气滞证（C错）。济生肾气丸用于治疗癃闭肾阳衰惫证（D错）。清肺饮用于治疗癃闭肺热壅盛证（E错）。